关于对流层，下列哪一项正确
A. 气温随高度的增加而升高
B. 气温随高度的增加而降低
C. 气温不随高度变化
D. 能反射无线电波
E. 能使地球生物免受射线损害

正确答案：B。气温随高度的增加而降低

解析：本题考查对流层的相关内容。对流层是指最接近地球表面的一层大气，也是大气的最下层，密度最大，所包含的空气质量几乎占整个大气质量的75%，以及几乎所有的水蒸气及气溶胶。在对流层中，气温随高度升高而降低（B对ACDE错），平均每上升100米，对流层气温约降低0.65℃。气温随高度升高而降低是由于对流层大气的主要热源是地面长波辐射，离地面越高，受热越少，气温就越低。